18岁患者主诉刷牙出血数月，查见牙松（-），牙龈红肿，牙周探诊深度≤3mm，牙石（++），探诊出血，最佳处理方案
A. 服用阿莫西林和甲硝唑
B. 口腔卫生宣教和龈上洁治术
C. 口腔卫生宣教，龈上洁治术，根面平整术
D. 服用牙周宁片，使用含漱剂
E. 进行牙龈切除术

正确答案：B。口腔卫生宣教和龈上洁治术

解析：本题考查慢性龈炎的治疗原则。患慢性龈炎的患者常在刷牙或咬硬物时牙龈出血，这也是牙龈炎患者就诊的主要原因，患慢性龈炎时，牙龈组织发生炎性肿胀，龈沟内探诊出血，根据患者的主诉与临床检查可判断患者患有慢性龈炎。慢性龈炎的治疗原则之一为去除病因，通过洁治术彻底清除菌斑、牙石，消除造成菌斑滞留和局部刺激牙龈的因素；同时为防止复发，积极开展椅旁口腔卫生宣教工作（B对），指导并教会患者控制菌斑的方法。对于不伴有全身疾病的慢性龈炎患者，不应全身使用抗菌药物如阿莫西林和甲硝唑（A错）。根面平整术（C错）是在去除龈下牙石的同时对牙根面外形进行修整，着重在于用器具去除软化的牙骨质，患者口腔检查牙松（-），且无深牙周袋，因此不必进行根面平整术。牙周宁片适用于牙周病引起的牙龈出血、牙周脓肿等病症，可结合洁治术治疗较重的牙龈炎症，只服用牙周宁片、使用含漱剂（D错）而不去除牙石不能从根本上去除致病因素。牙龈切除术（E错）是使用手术方法切除增生肥大的牙龈组织或后牙某些部位的中等深度牙周袋，重建牙龈的生理外形及正常的龈沟，该患者既无增生肥大的牙龈组织也无深牙周袋，因而不宜进行牙龈切除术。